在匹配设计的病例对照研究中，以下说法错误的是
A. 设计时，可进行成组匹配设计
B. 设计时，可进行个体匹配设计
C. 应将非研究因素尽可能都加以匹配
D. 应将确定的或怀疑的混杂因素进行匹配
E. 分析时，可采用分层分析或多元统计分析方法

正确答案：C。应将非研究因素尽可能都加以匹配